胃平滑肌的慢波频率约为多少
A. 2次/分
B. 3次/分
C. 4次/分
D. 5次/分
E. 6次/分

正确答案：B。3次/分